男，52岁。乏力纳差12年，丙氨酸氨基转移酶间断升高，1个月来尿少，双下肢水肿，腹胀逐渐加重。3天前腹泻黄稀水样便3次，2天来腹痛发热，T38.5℃，该患者最可能诊断是
A. 胆系感染
B. 肝硬化并原发性腹膜炎
C. 结核性腹膜炎
D. 急性细菌性痢疾
E. 肝癌破裂

正确答案：B。肝硬化并原发性腹膜炎

解析：中年男性患者，乏力纳差12年、丙氨酸氨基转移酶间断升高（提示肝功能异常），双下肢水肿（考虑为肝硬化导致的低白蛋白血症引起的组织间隙水肿所致）。患者长期肝功能异常，可能发生肝硬化。肝硬化患者出现腹痛、发热（自发性细菌性腹膜炎最常见的症状），腹胀逐渐加重（考虑为腹膜刺激征导致肠蠕动减慢和腹水增加所致，自发性细菌性腹膜炎的典型体征）。综合患者的病史、症状、体征，该患者最可能诊断是肝硬化并原发性腹膜炎（B对）。胆系感染（A错）常主要是右上腹部疼痛，黄疸，轻度至中度发热，严重可出现寒战高热，一般不出现腹水。结核性腹膜炎（C错）常有结核病史，低热盗汗，腹壁柔韧感。急性细菌性痢疾（D错）多有不洁饮食史或与菌痢患者接触史，常表现为高热，腹痛腹泻，伴有里急后重及黏液脓血便。肝癌破裂（E错）常表现突发性的腹部剧烈疼痛。